男，40岁。渐起走路不稳2年，有共济失调障碍，步幅加宽，左右摇摆。最可能受损的部位是
A. 小脑半球
B. 小脑蚓部
C. 丘脑
D. 延髓
E. 大脑半球

正确答案：B。小脑蚓部

解析：患者中年男性，渐起走路不稳2年，有共济失调障碍，步幅加宽，左右摇摆，是躯干共济失调的表现，最可能的受损部位是小脑蚓部（B对）。小脑半球（A错）损害表现为同侧肢体共济失调，指鼻试验、跟膝胫试验、轮替试验笨拙，眼球震颤，小脑性语言（P19）。丘脑（C错）损害表现为对侧感觉缺失和（或）刺激症状，对侧不自主运动，并有感情与记忆障碍（P11）。延髓（D错）损害表现为延髓背外侧综合征或延髓内侧综合征（P14）。大脑半球（E错）损害分优势半球损害和非优势半球损害，前者出现语言、逻辑思维、分析综合能力及计算功能的障碍，后者表现为图形、几何、空间、人物面容、视觉记忆等方面的功能缺失（P4）。